我国食品中的AFB₁允许量规定代乳食品
A. ≤10μg/kg
B. ≤20μg/kg
C. ≤5μg/kg
D. ≤15μg/kg
E. 不得检出

正确答案：E。不得检出